胃气阴两伤常见的舌苔是
A. 无根苔
B. 焦黄苔
C. 花剥苔
D. 黑燥苔
E. 积粉苔

正确答案：C。花剥苔

解析：本题考查的是望舌苔的主要内容及临床意义。胃气阴两伤常见的舌苔是花剥苔（C对）。剥落：苔的有无与消长变化，是正邪斗争互为消长的表现。若舌苔骤然退去，不再复生，以致舌面光洁如镜，即为光剥舌，又叫“镜面舌”，是胃阴枯竭、胃气大伤的表现。若舌苔剥落不全，剥脱处光滑无苔，称为“花剥苔”，也属胃的气阴两伤之候。若花剥而兼有腻苔者，说明痰浊未化、正气已伤，病情较为复杂。无根苔（A错）指舌苔不着实，似浮涂在舌上，刮之即去，不像是从舌上生出来的，则为无根苔，又称假苔。一般来说无根舌多见于虚证、寒证，表示胃气衰。焦黄苔（B错）为热结。黑燥苔（D错）：苔黑而燥裂，甚则生芒刺，多为热极津枯。积粉苔（E错）指舌上满布白苔，有如白粉堆积在舌上，扪之不燥，为积粉苔，由于外感秽浊不正之气，毒热内盛所致，常见于瘟疫，亦见于内痈。